神经冲动释放的去甲肾上腺素主要
A. 被胆碱酯酶代谢
B. 被单胺氧化酶代谢
C. 被突触前膜重摄取
D. 经肝脏代谢破坏
E. 进入血液，重分布于机体各组织

正确答案：C。被突触前膜重摄取